感染性心内膜炎最常见的并发症是
A. 脑栓塞
B. 细菌性动脉瘤破裂
C. 心力衰竭
D. 肾功能不全
E. 脾破裂

正确答案：C。心力衰竭

解析：感染性心内膜炎最常见的并发症是心力衰竭，主要有瓣膜关闭不全所致，主动脉瓣受损者最常发生（75%），其次为二尖瓣（50%）和三尖瓣（19%）；瓣膜穿孔或者腱索断裂导致急性瓣膜关闭不全时可诱发急性左心衰竭。掌握“自体瓣膜感染性心内膜炎”知识点。